干呕呃逆，胃脘嘈杂，口干咽燥，舌红少苔。其证候是
A. 食滞胃脘
B. 胃阴虚
C. 肝脾不调
D. 肝胃不和
E. 胃阳虚

正确答案：B。胃阴虚

解析：胃阴亏虚，胃失和降，胃气上逆，可见干呕呃逆；胃阴不足，虚热内生，胃失和降，则胃脘嘈杂；阴津不能上滋，则口燥咽干；舌红少苔为阴液亏少之征（B对）。食滞胃肠证指饮食停积胃肠，以脘腹痞胀疼痛、呕泻酸馊腐臭等为主要表现的证候（A错）。肝脾不调证指肝失疏泄，脾失健运，以胁肋作痛、情志抑郁、腹胀、便溏等为主要表现的证候（C错）。肝胃不和证指肝气郁结，胃失和降，以脘胁胀痛、嗳气、吞酸、情绪抑郁等为主要表现的证候（D错）。胃阳虚证指阳气不足，胃失温煦，以胃脘冷痛、喜温喜按，畏冷肢凉为主要表现的虚寒证候（E错）。